肾阳虚的表现不包括
A. 小便清长
B. 腰膝酸软
C. 遗精盗汗
D. 面色黧黑
E. 滑精早泄

正确答案：C。遗精盗汗

解析：肾阳虚衰，不能温养筋骨、腰膝，则腰膝酸软冷痛（B对）；若肾阳衰惫，阴寒内盛，则本脏之色外现而面色黧黑（D对）；肾阳虚弱，固摄失司，则男子滑精、早泄（E对），女子白带清稀量多，尿频清长，夜尿多（A对）。盗汗多见于阴虚证（C错，为本题正确答案）。